主要由自身反应性T细胞介导的自身免疫病是
A. 肺出血肾炎综合征
B. 桥本甲状腺炎
C. 免疫性血小板减少性紫癜
D. 重症肌无力
E. 胰岛素抗性糖尿病

正确答案：B。桥本甲状腺炎

解析：体内存在的针对自身抗原的自身反应性T淋巴细胞在一定条件下可引发自身免疫性疾病，桥本甲状腺炎（B对）是自身反应性T淋巴细胞的自身免疫病，但也可由自身抗体所介导，答案不严谨。需要注意的是，胰岛素依赖性糖尿病也是自身反应性T细胞介导的自身免疫病，但本题E选项为胰岛素抗性糖尿病，注意区分。肺出血肾炎综合征（A错）、免疫性血小板减少性紫癜（C错）、重症肌无力（D错）、胰岛素抗性糖尿病（E错）是自身抗体介导的自身免疫病。